欲编制某地区某特定人群的寿命表，需利用该人群的
A. 总死亡数
B. 总死亡率
C. 人口年龄构成
D. 年龄别死亡率
E. 不同性别的死亡率

正确答案：D。年龄别死亡率